下列有关内耳的描述,不正确的是
A. 由骨迷路、膜迷路和前庭组成
B. 膜迷路管腔内充满内淋巴
C. 骨迷路与膜迷路间充满外淋巴
D. 壶腹嵴可感受旋转变速运动的刺激
E. 前庭窗后上方的弓形隆起为面神经管凸,内有展神经通过

正确答案：A。由骨迷路、膜迷路和前庭组成

解析：内耳又称迷路，由骨迷路和膜迷路两部分组成（A错，为本题正确答案）。骨迷路与膜迷路之间充满外淋巴（C对），膜迷路内充满内淋巴（B对），内、外淋巴互不相通。壶腹峭是位觉感受器，能感受头部旋转变速运动的刺激（D对）。